当某县出现疫情时，该县卫生行政部门可以直接实行的措施为
A. 积极组织力量防治
B. 对疫区进行封锁
C. 限制人员流动
D. 停工、停业、停课
E. 封闭可能造成传染病扩散的场所

正确答案：A。积极组织力量防治

解析：当某县出现疫情时，该县卫生行政部门可以直接实行的措施为积极组织力量防治（A对）。对疫区进行封锁（B错）；限制人员流动（C错）；停工、停业、停课（D错）；封闭可能造成传染病扩散的场所（E错）县级政府不能直接施行，都要报经上一级人民政府决定，才可以采取这些措施。